具有明显肝肠循环的药物是
A. 洋地黄毒苷
B. 地高辛
C. 阿托品
D. 哌替啶
E. 考来烯胺

正确答案：A。洋地黄毒苷